听觉适应是指短时间暴露在噪声环境中检查时听阈提高
A. 10dB
B. ＞30dB
C. 10～15dB
D. 15～20dB
E. 20～30dB

正确答案：C。10～15dB